下列各项中，不属于小儿病理特点的是
A. 传变迅速
B. 发病容易
C. 易趋康复
D. 脏腑充实
E. 脏气清灵

正确答案：D。脏腑充实

解析：小儿的病理特点是由其生理特点决定的，表现为发病容易（B对）、传遍迅速（A对），由于脏腑娇嫩，形气未充，形体和功能均较弱，对疾病的抵抗力较差，加之寒暖不能自调，乳食不知自节，一旦调护失宜，外易为六淫所侵，内易为饮食所伤，故病理上表现为易于发病，易于传变，年龄越小则越显突出；脏气清灵（C对）、易趋康复（E对），小儿患病后传变迅速，疾病的寒热虚实容易相互转化或同时并见，即“易虚易实，易寒易热”，同时由于小儿活力充沛，对药物的反应灵敏，病因单纯，若能得到及时的治疗和护理，可迅速恢复健康。选项脏腑充实表述错误，小儿应该是脏腑娇嫩，形气未充，不属于小儿病理特点（D错，为本题正确答案）。